脑立清丸主治
A. 痰湿内蕴之头晕目眩
B. 风热上攻之头晕目眩
C. 肝阳上亢之头晕目眩
D. 肝火上炎之头痛目赤
E. 精血亏虚之头晕目眩

正确答案：C。肝阳上亢之头晕目眩

解析：本题考查的是脑立清丸的主治。脑立清丸主治肝阳上亢之头晕目眩（C对）。脑立清丸：【主治】肝阳上亢所致的头晕目眩、耳鸣口苦、心烦难寐；高血压见上述证候者。黄连上清丸：【主治】风热上攻、肺胃热盛所致的头晕目眩（B错）、暴发火眼、牙齿疼痛、口舌生疮、咽喉肿痛、耳痛耳鸣、大便秘结、小便短赤。龙胆：【主治病证】（1）湿热下注之阴肿阴痒、带下、阴囊湿疹，湿热黄疸。（2）肝火上炎之头痛目赤（D错）、耳聋胁痛等。（3）高热抽搐，小儿急惊，带状疱疹。熟地黄：【主治病证】（1）血虚萎黄、眩晕、心悸、月经不调、崩漏。（2）肾阴不足之潮热、盗汗、遗精，消渴。（3）精血亏虚之腰酸脚软、头晕眼花（E错）、耳聋耳鸣、须发早白。主治为痰湿内蕴之头晕目眩（A错）的中成药，2022年考试指南未明确说明。